正确叙述前锯肌的是
A. 以齿状的肌束起自上6个肋骨的外侧面
B. 以齿状的肌束起自全部肋骨的外侧面
C. 止于肩胛骨的外侧缘和下角
D. 下部肌束收缩可使肩胛骨下角内旋
E. 当肩胛骨固定时，它收缩可上提肋骨

正确答案：E。当肩胛骨固定时，它收缩可上提肋骨

解析：前锯肌以齿状的肌束起自上8～9个肋骨的外侧面，而非上6个肋骨的外侧面（A错），也非全部肋骨的外侧面（B错），止于肩胛骨内侧缘和下角，而非肩胛骨的外侧缘和下角（C错）。肩胛骨的下部肌束收缩可使肩胛骨下角外旋，而非内旋（D错）。当肩胛骨固定时，它收缩可上提肋骨（E对）以协助深吸气。